粉末显微特征中，有晶纤维和不规则分枝状石细胞的药材是
A. 秦皮
B. 肉桂
C. 厚朴
D. 杜仲
E. 黄柏

正确答案：E。黄柏

解析：本题考查的是黄柏的显微鉴别。粉末显微特征中，有晶纤维和不规则分枝状石细胞的药材是黄柏（E对）。黄柏【显微鉴别】粉末：绿黄色或黄色。①纤维鲜黄色，直径16～38㎛，常成束，周围的细胞含草酸钙方晶，形成晶纤维；含晶细胞壁木化增厚。②石细胞众多，鲜黄色，类圆形或纺锤形，长径35～80㎛，有的呈分枝状，壁厚，层纹明显。③草酸钙方晶极多，直径12～30㎛。④淀粉粒呈球形，直径不超过10㎛。⑤黏液细胞可见，呈类球形，直径32～42㎛。秦皮（A错）【显微鉴别】苦枥白蜡树树皮横切面：①木栓层为5～10余列细胞，部分内壁增厚，木栓化。②栓内层为数列多角形厚角细胞。③皮层较宽，有纤维及石细胞单个散在或成群。④薄壁细胞中含多数淀粉粒、草酸钙砂晶。肉桂（B错）【显微鉴别】粉末：红棕色。①纤维多单个散在，少数2～3个并列，长梭形，平直或波状弯曲。②石细胞类圆形或类方形。③油细胞类圆形或长圆形，含黄色油滴状物。④草酸钙针晶或柱晶较细小，成束或零星散在于射线细胞中。⑤木栓细胞多角形，含红棕色物质。⑥淀粉粒极多，圆球形或多角形。⑦草酸钙结晶片状。厚朴（C错）【显微鉴别】粉末：石细胞类方形、椭圆形或不规则分枝状，直径11～65㎛，壁厚，有的可见层纹。油细胞椭圆形或类圆形，含黄棕色油状物。纤维甚多，壁甚厚，有的呈波浪形或一边呈锯齿状，木化，孔沟不明显。杜仲（D错）【显微鉴别】粉末：呈棕色。①石细胞众多，大多成群，类长方形、类圆形或不规则形。②橡胶丝成条或扭曲成团。③木栓细胞成群或单个，表面观呈多角形。④淀粉粒类圆形。